患儿10个月，人工喂养未加副食，平素很少到户外活动，因发热、咳嗽、气促2天以支气管肺炎收住院，突起惊厥，其急诊处理步骤应是
A. 补钙→止惊→维生素D
B. 止惊→补钙→维生素D
C. 维生素D→止惊→补钙
D. 补钙→维生素D→止惊
E. 维生素D→补钙→止惊

正确答案：B。止惊→补钙→维生素D

解析：本题考维生素D缺乏性佝偻病的治疗措施。该患儿10个月，人工喂养未加副食，且平素很少到户外活动，因发热、咳嗽、气促2天以支气管肺炎收住院，突起惊厥，其急诊处理步骤应是止惊→补钙→维生素D（B对ACDE错）。